根据《城镇职基本医疗保险定点零售药店管理暂行办法》，外配处方必须由
A. 定点医疗机构医师开具
B. 定点零售药店执业药师开具
C. 乡镇卫生院全科医师开具
D. 个体诊所医师开具
E. 定点医疗机构的临床药师开具

正确答案：A。定点医疗机构医师开具

解析：本题考查定点零售药店管理。根据《城镇职基本医疗保险定点零售药店管理暂行办法》，外配处方必须由定点医疗机构医师开具（A对）。